60岁的男性急性肾功能衰竭病人，血钾5.6mmol/L，下列治疗措施有原则性错误的是
A. 10%氯化钾20ml静脉滴注
B. 口服钠型树脂15g，一日三次
C. 山梨醇5g，每2小时口服一次
D. 5%碳酸氢钠溶液100ml，缓慢静脉滴注
E. 25%葡萄糖溶液加胰岛素（3～5g：1u）200ml，缓慢静脉滴注

正确答案：A。10%氯化钾20ml静脉滴注

解析：中老年男性急性肾功能衰竭患者（提示患者存在水电解质失衡及代谢性酸中毒可能），血钾5.6mmol/L（正常值3.5～5.5mmol/L），细胞外液处于轻度高钾状态，但患者存在急性肾功能衰竭，因此血钾可在短期内迅速升高，易致心律失常，需降低血钾，而不是补钾（A错，为本题正确答案）。口服钠型树脂15g，一日三次（B对）是用树脂中的Na⁺置换出胃肠道中的K⁺、H⁺从而降低血钾及纠正代酸。山梨醇5g，每2小时口服一次（C对）可以达到从肠道渗透性脱水作用，减轻水潴留。5%碳酸氢钠溶液100ml，缓慢静脉滴注（D对）可同时达到降钾及纠正代谢性酸中毒的作用。25%葡萄糖溶液加胰岛素（3～5g：1u）200ml，缓慢静脉滴注（E对）可降钾。